临床Ⅱ期
A. T1N2M1
B. T1N0M0
C. T2N0M0
D. T1N2M0
E. T2N1M0以上TNM分类法中，各属口腔癌临床哪一期

正确答案：C。T2N0M0

解析：掌握“口腔颌面部肿瘤的治疗原则及预防”知识点。